由于下丘脑对性激素的负反馈敏感性下降，使促性腺素释放激素过早分泌所致的性早熟叫做早熟
A. 外周性
B. 继发性
C. 特发性
D. 假性
E. 部分性

正确答案：C。特发性

解析：真性性早熟中“特发性性早熟”是发病最普遍的一种，占女孩性早熟80%以上，占男孩性早熟40%左右，绝大多数在4～8岁出现，发育顺序与正常青春期发育相似，但提前并加速。由于骨骺成熟加速，骨骼提前融合，成年后身材将较正常人矮小（C对）。假性性早熟又称外周性性早熟，非受控于HPGA轴，有第二性征的发育和性激素水平的升高，但是患儿的HPGA轴并未启动，反而受到体内存在的性激素的负反馈抑制，无性腺的发育（A错）。继发性性早熟多见于中枢神经系统异常，包括：肿瘤或占位性病变：下丘脑错构瘤、囊肿、肉芽肿，中枢神经系统感染，获得性损伤：外伤、术后放疗或化疗，发育异常：脑积水、视中隔发育不全等（B错）。假性性早熟是指第二性征发育与性腺发育步调不一致，而睾丸或卵巢本身并未发育，但部分第二性征却提前出现的疾病。它的原因比较明确，如下丘脑、松果体、卵巢、肾上腺皮质、绒毛膜上皮等部位发生肿瘤或病毒性脑膜炎后遗症导致性激素大量分泌。此外，由于外源性激素如误服避孕药、服用含激素的补品以及使用含激素的化妆品而导致儿童假性性早熟（D错）。部分性性早熟包括单纯乳房早发育、单纯性阴毛早发育、单纯性早初潮（E错）。